西医学的颈部急性淋巴结炎，相当于中医学的
A. 蛇眼疔
B. 红丝疔
C. 颈痈
D. 有头疽
E. 烂疔

正确答案：C。颈痈

解析：颈痈是发生在颈部两侧的急性化脓性疾病，相当于西医的颈部化脓性淋巴结炎（C对）。蛇眼疔（A错）是生在指甲旁的急性化脓性疾病。红丝疔（B错）是因手足部皮肤破损，感染邪毒化火，走窜经络，导致四肢红丝显露，迅速向上走窜的急性感染性疾病。相当于西医的急性淋巴管炎。有头疽（D错）是发生在肌肤间的急性化脓性疾病，相当于西医的痈。烂疔（E错）是指发生在皮肉间，容易腐烂，病势暴急，易并发走黄的急性感染性疾病，相当于西医的气性坏疽。